下列哪种物质不是光化学烟雾的主要成分
A. O₃
B. 过氧苯酰硝酸酯
C. 甲醛
D. CO
E. 过氧乙酰硝酸酯

正确答案：D。CO

解析：本题考查光化学烟雾的主要成分。光化学烟雾是汽车、工厂等污染源排入大气的碳氢化合物（HC）和氮氧化物（NOx）等一次污染物在阳光（紫外光）作用下发生光化学反应生成二次污染物后与一次污染物混合所形成的有害浅蓝色烟雾。其成分复杂，主要包括臭氧（A对）、醛类（C对）以及各种过氧酰基硝酸酯（BE对）等多种成分。CO（D错，为本题正确答案）不是光化学烟雾的主要成分。